导致津液输布障碍，水湿痰饮内停的最主要因素是
A. 肺的宣发肃降失职
B. 脾的运化功能失健
C. 肝的疏泄功能失常
D. 肾的主水功能失调
E. 三焦疏通水道不利

正确答案：B。脾的运化功能失健

解析：津液的输布主要依靠脾、肺、肾、肝和三焦等脏腑生理功能的协调配合来完成，本题的解题关键在于津液输布障碍和最主要因素。肺通调水道而行水，依靠肺气的宣发肃降输布津液。肾主水，肾气及肾阴肾阳对津液输布具有推动和调节作用。肝调畅气机以行水，气行则津布。三焦决渎为水道，津液得以正常输布。然而这些功能都是协调配合脾来完成（ACDE错），脾气散精以输布津液。脾输布津液主要有两条途径：一是将津液上输于肺，通过肺气的宣发肃降，使津液输布千全身而灌溉脏腑、形体和官窍。二是直接将津液向四周布散至全身，即脾有“灌溉四傍”的功能（B对）。